启膈散适用于噎膈的哪种证型
A. 气虚阳微证
B. 津亏热结证
C. 痰气交阻证
D. 瘀血内结证
E. 以上都不是

正确答案：C。痰气交阻证

解析：启膈散功用为为开郁化痰，润燥降气，故适用于痰气交阻证（C对）。气虚阳微证（A错）的治法为温补脾肾，益气回阳，方药选用补气运脾汤加减；津亏热结证（B错）的治法用清热散结，滋阴润燥，方药选用五汁安中饮加减；瘀血内结证（D错）治法为养血祛瘀，破结软坚，方药选用通幽汤加减。